都可采用升提中气法治疗，此属于
A. 因人制宜
B. 同病异治
C. 异病同治
D. 审因论治
E. 虚则补之

正确答案：C。异病同治

解析：题中久痢、脱肛、子宫下垂均为中气不足所致，均可采用升提中气的治法来治疗，即不同的疾病在发展过程中出现了相同的病机和证，因此可采用相同的治法，即异病同治（C对）。因人制宜是指不同的患者有不同的个体特点，在治疗疾病时应根据每个患者的年龄、性别、体质等不同的个体特点来确定适宜的治疗原则（A错）。同病异治是指同一种疾病由于其发病时间、地区及机体反应性的不同，或疾病处于不同的发展阶段，所以表现的证不同，故治法亦不同（B错）。审因论治是指在利用病因理论分析疾病的症状和体征，指导出疾病发生的原因和机理，得出以病因命名的证候，审查病因，确定治法方药（D错）。虚则补之即用补益药来治疗虚证（E错）。